龋齿充填治疗一段时间之后，在充填物边缘出现继发龋，对于其中原因，叙述不正确的是
A. 材料本身性能不良或材料调制不当
B. 制备洞外形时未作预防性扩展
C. 填充材料未与洞缘紧密贴合
D. 充填物在口腔内经过一段时间后产生折裂
E. 粘于洞缘侧壁的材料被唾液溶解

正确答案：D。充填物在口腔内经过一段时间后产生折裂

解析：经充填治疗后，在洞边缘或洞内壁，再次出现龋坏原因：制备洞外形时邻近深窝沟或可疑龋未作预防性扩展或未做窝沟封闭，而在洞缘产生龋坏；材料本身性能不良或材料调制不当，使充填体与洞缘出现微缝；填充材料未压紧或未与洞缘紧密贴合而出现微缝；垫底不当，粘于洞缘侧壁的垫底材料被唾液溶解而出现缝隙，逐渐龋坏。充填物在口腔内经过一段时间后产生折裂（D错），可引起食物嵌塞等，多不会引起继发龋，临床操作中需重新按照正规操作要求完成牙体的粘结修复。掌握“龋病治疗出现问题及处理”知识点。